属于非极性溶剂的是
A. 甘油
B. 乙醇
C. 丙二醇
D. 液体石蜡
E. 聚乙二醇

正确答案：D。液体石蜡

解析：本题考查非极性溶剂。液体石蜡（D对）为非极性溶剂；甘油（A错）为极性溶剂；乙醇（B错）、丙二醇（C错）和聚乙二醇（E错）为半极性溶剂。